男，53岁。在最近的一次体检中发现背部皮下有一黄豆大小的包块，体检报继议他去相关科室进一步检查。专科检查后，告诉他不是大问题，如不放心可以观察一段时间，看此包块是否增大再作处理。为此患者吃不下饭睡不好觉，出现了焦虑反应。调整其不良情绪的方法中，不恰当的为
A. 调整期望目标
B. 改变生活环境
C. 学习放松方法
D. 改变认知方式
E. 应用心理防御

正确答案：A。调整期望目标

解析：本题考查调整不良情绪的方法。男，53岁。在最近的一次体检中发现背部皮下有一黄豆大小的包块，体检报继议他去相关科室进一步检查。专科检查后，告诉他不是大问题，如不放心可以观察一段时间，看此包块是否增大再作处理。为此患者吃不下饭睡不好觉，出现了焦虑反应。调整其不良情绪的方法中，不恰当的为调整期望目标（A错，为本题的正确答案）。改变生活环境（B对）、学习放松方法（C对）、改变认知方式（D对）、应用心理防御（E对）均为该患者调整其不良情绪的方法。